木香粉末的显微特征有
A. 菊糖多见，表面现放射状纹理
B. 油室碎片淡黄色
C. 网纹导管多见
D. 木纤维多成柬，长梭形，纹孔及孔沟明显
E. 石细胞呈方形、长方形或多角形，壁不甚厚

正确答案：A、B、C、D。菊糖多见，表面现放射状纹理；油室碎片淡黄色；网纹导管多见；木纤维多成柬，长梭形，纹孔及孔沟明显